治疗缺铁性贫血气血两虚证，应首选
A. 香砂六君子汤
B. 八珍汤
C. 四神丸
D. 四物汤
E. 金匮肾气丸

正确答案：B。八珍汤

解析：缺铁性贫血气血两虚证，治宜益气补血，养心安神，首选益气补血的八珍汤（B对）。香砂六君子汤功用益气健脾，行气化痰，是治疗缺铁性贫血脾气虚弱证的代表方（A错）。四神汤补益脾阴，厚实肠胃，是中医著名的健脾食方，用于治疗脾虚，脾阴不足，消化不良等（C错）。四物汤功用补血和血，适用于营血虚滞证（D错）。金匮肾气丸补肾助阳，化生肾气，适用于肾阳气不足证（E错）。